女孩，5岁。因间断发热伴痉挛性咳嗽20天来诊。体温38℃，神志清。慢性病容，右眼结膜充血。内眦部有一疱疹，咽部有充血，右颈部可触及豌豆大小淋巴结，无明显压痛，心、肺无异常。肝肋下1.0cm，胸透肺门可见3cm×3cm阴影，外周血白细胞5.6×10⁹/L，淋巴细胞0.7。对该患儿的同胞兄弟应采取哪项最佳预防措施
A. 呼吸道隔离
B. 红霉素口服7~10天
C. 异烟肼口服6个月
D. 定期体检，早期发现
E. 尽早接种卡介苗

正确答案：C。异烟肼口服6个月

解析：学龄前儿童，间断发热伴痉挛性咳嗽20天来诊，体温38℃（正常值为36℃～37℃，发热），神志清，慢性病容，右眼结膜充血，内眦部有一疱疹，咽部有充血，右颈部可触及豌豆大小淋巴结，无明显压痛，肝肋下1.0cm（提示肝脏增大），胸透肺门可见3cm×3cm阴影（支气管淋巴结结核的典型X线表现），外周血白细胞5.6×10⁹/L（正常值为4～10×10⁹/L），淋巴细胞0.7（正常值为0.2～0.4，淋巴细胞增高），根据患儿的临床症状、体征及实验室检查，考虑最可能的诊断为支气管淋巴结结核，由于该患儿的同胞兄弟属于密切接触家庭内开放性肺结核者，所以应采取的最佳预防措施是异烟肼口服6个月（C对），卡介苗接种（E错）主要用于新生儿的预防。